下列关于输尿管的描述，正确的是
A. 起自肾门
B. 属于腹膜外位器官
C. 分为盆、腹两段
D. 开口于膀胱体的两侧
E. 全程行于腰大肌前面

正确答案：B。属于腹膜外位器官

解析：输尿管属于腹膜外位器官（B对），起自肾盂末端（A错），全长可分为腹部、盆部和壁内部（C错）。其中只有输尿管腹部行于腰大肌前面（E错），最后开口于膀胱底而非膀胱体（D错）。